心功能不全肺淤血时，在痰中出现的是
A. 白细胞
B. 夏科-雷登结晶体
C. 上皮细胞
D. 色素细胞
E. 杜什曼螺旋体

正确答案：D。色素细胞

解析：心功能不全肺淤血时，在痰中出现的是色素细胞（D对）即含铁血黄素细胞。白细胞（A错）和上皮细胞（C错）可出现于正常人或肺部感染性疾病患者的痰液中。夏科-雷登结晶体（B错）是嗜酸粒细胞破裂后嗜酸性颗粒相互融合而成的结晶体，可在支气管哮喘患者痰中出现。杜什曼螺旋体（E错）可在少数支气管哮喘患者痰中出现。